男，38岁。因反复左侧头痛半年，加重伴呕吐3天于急诊留观。查体：浅昏迷，双侧瞳孔为左侧3mm，右侧2mm，对光反应迟钝。右侧肢体肌力4级，右侧Babinski征阳性。为明确诊断应首选的最简洁的检查方法是
A. 经颅彩色多普勒超声
B. 脑电图
C. 头颅MRI
D. 头颅X线片
E. 头颅CT

正确答案：E。头颅CT

解析：患者初步诊断为颅脑肿瘤，应立即采用头颅CT（E对）检查以明确诊断。经颅彩色多普勒超声（A错）只能检查颅脑血流情况。脑电图（B错）主要用于癫痫发作的诊断，对脑疝诊断意义不大。头颅MRI（C错）耗时长、花费大，不适用于脑疝的严重患者。头颅X线片（D错）仅能显示颅骨的情况，不能显示脑组织的情况。